中性粒细胞碱性磷酸酶活性明显增高见于
A. 慢性粒细胞白血病
B. 类白血病反应
C. 急性粒细胞白血病
D. 急性淋巴细胞白血病
E. 淋巴瘤

正确答案：B。类白血病反应

解析：中性粒细胞碱性磷酸酶（NAP）主要存在于成熟阶段的中性粒细胞，其他细胞均成阴性反应。中性粒细胞碱性磷酸酶升高主要见于急性化脓性感染、再生障碍性贫血、类白血病反应（B对）。类白血病反应并非真正的白血病，常并发于严重感染、恶性肿瘤等疾病，NAP反应强阳性。白血病表现为白细胞成熟障碍，中性粒细胞碱性磷酸酶活性降低（AC错）。急性淋巴细胞白血病（D错）的NAP积分值多增高。淋巴瘤（E错）NAP活性中度升高。